分布于下睑、鼻翼、上唇皮肤的神经是
A. 上牙槽神经
B. 颊神经
C. 眶下神经
D. 面神经颊支
E. 无

正确答案：C。眶下神经

解析：分布于下睑、鼻翼、上唇皮肤的神经是眶下神经（C对），为感觉性神经。上牙槽神经（A错）为感觉性神经，分布于上颌牙、牙龈及上颌窦黏膜。颊神经（B错）为感觉性神经，分布于颊部皮肤及口腔侧壁黏膜。面神经颊支（D错）为运动性神经，支配颊肌、口轮匝肌及其他口周围肌。